患有甲型病毒性肝炎、戊型病毒性肝炎、细菌性痢疾、伤寒、活动性肺结核、化脓性或渗出性皮肤病等疾病的从业人员
A. 及时进行治疗但不用调离工作岗位
B. 在治愈前不得从事直接为顾客服务的工作
C. 不能再从事任何工作
D. 治愈后也不能上岗继续工作
E. 定期体检但不用调离工作岗位

正确答案：B。在治愈前不得从事直接为顾客服务的工作

解析：本题考查公共场所从业人员的健康检查制度。公共场所的经营者应负责组织本单位从业人员的健康检查工作，获得有效健康证方可上岗，患有甲型病毒性肝炎、戊型病毒性肝炎、细菌性痢疾、伤寒、活动性肺结核、化脓性或渗出性皮肤病等疾病的从业人员，在治愈前不得从事直接为顾客服务的工作（B对ACDE错）。